应在餐前服用的药物是
A. 氨茶碱片
B. 吡罗昔康片
C. 呋塞米片
D. 胶体果胶铋胶囊
E. 头孢呋辛酯片

正确答案：D。胶体果胶铋胶囊

解析：本题考查餐前服用的药物。胶体果胶铋（D对）在餐前1h服用，睡前用。吡罗昔康片（B错）宜于餐中服用。呋塞米（C错）宜于清晨服用。氨茶碱片（A错）与头孢呋辛酯片（E错），最新版考试指南未明确说明。